表示人群中由于某因素引起发病的危险性占整个人群发病的比例
A. RR
B. AR
C. AR%
D. OR
E. PAR%

正确答案：E。PAR%